乌脚病是由于长期饮用了下列哪种水而引起的疾病
A. 含氟量高
B. 含碘量低
C. 含砷量高
D. 含汞量高
E. 含碘量高

正确答案：C。含砷量高

解析：本题考查乌脚病。乌脚病是由于长期饮用了含砷量高（C对ABDE错）的水而引起的疾病。砷是一种有毒的金属元素，它可以通过水体进入人体，并通过血液运输到全身，在肌肉和骨骼组织中积累，从而导致乌脚病的发生。